牙周翻瓣术中能彻底切除袋内壁上皮和感染组织的切口是
A. 牙间水平切口
B. 沟内切口
C. 外斜切口
D. 内斜切口
E. 纵切口

正确答案：A。牙间水平切口

解析：本题考查牙周翻瓣术的切口设计。牙周翻瓣术中能彻底切除袋内壁上皮和感染组织的切口是牙间水平切口（A对）。又叫第三切口，龈瓣翻开后，将刀片与牙面垂直，在骨嵴顶的冠方，水平地切断袋壁组织与骨嵴顶及牙面的连接，从颊舌方向将欲切除的组织从骨嵴顶和牙面彻底分离。沟内切口（B错）是将刀片从袋底切入，直达牙槽嵴顶或其附近，目的是将欲切除的袋壁组织与牙面分离。外斜切口（C错）为牙龈切除术中所做切口。牙周翻瓣术的内斜切口（D错）一般在距龈缘0.5～2mm处进刀，向根方切入，直达牙槽嵴顶或其附近，将牙周袋内壁上皮和炎症组织切除，形成创面朝向根面的龈瓣。纵切口（E错）是在水平切口的近中端或近、远中两端做的纵行切口，目的是减少组织张力，更好地暴露术区。